环口苍白圈见于
A. 麻疹
B. 风疹
C. 幼儿急疹
D. 手足口病
E. 烂喉丹痧

正确答案：E。烂喉丹痧

解析：烂喉丹痧也称烂喉痧、疫疹，本病相当于西医的猩红热。出疹期面颊充血潮红，唯口唇周围苍白，称环口苍白圈（E对）。疹指皮肤出现红色或紫红色、粟粒状疹点，高出皮肤，抚之碍手，压之褪色，常见于麻疹（A错）、风疹（B错）等病。幼儿急疹特点是烧退疹出或疹出热退。皮疹多不规则，为小型玫瑰斑点，也可融合一片，压之消退（C错）。手足口病口腔、咽、软腭、颊黏膜、舌、齿龈出现疼痛性粟粒至绿豆大小水疱，周围绕以红晕，破溃成小溃疡，由于疼痛，常流涎和拒食（D错）。